治疗病毒性乙型肝炎的一线药物是
A. 利巴韦林
B. 依非韦伦
C. 阿昔洛韦
D. 拉米夫定
E. 替诺福韦

正确答案：E。替诺福韦

解析：本题考查替诺福韦酯。治疗病毒性乙型肝炎的一线药物是替诺福韦酯（E对）。基于抗病毒疗效和耐药方面的优势，恩替卡韦和替诺福韦被推荐为临床治疗乙肝的一线药物。替比夫定、阿德福韦和拉米夫定（D错）为二线药物。利巴韦林（A错）用于治疗慢性丙型肝炎。依非韦伦（B错）用于艾滋病的治疗。阿昔洛韦（C错）用于单纯疱疹的治疗。